诊断进行性血胸，错误的是
A. Hb、RBC反复测定呈进行性下降
B. 经输血补液血压不回升或回升后又迅速下降
C. 脉快、血压持续下降
D. 胸穿抽不出血，X线示胸膜腔阴影增大
E. 胸腔引流连续3小时总量达200ml

正确答案：E。胸腔引流连续3小时总量达200ml

解析：诊断进行性血胸错误的是胸腔引流连续3小时总量达200ml（E错，为本题正确答案），应该是闭式胸腔引流量每小时超过200ml，持续3小时。Hb、RBC反复测定呈进行性下降（A对）；经输血补液血压不回升或回升后又迅速下降（B对）；脉快、血压持续下降（C对）；胸穿抽不出血，X线示胸膜腔阴影增大（D对）这些征象都提示出血没有停止，为进行性血胸。